过度悲伤可引起
A. 精神不能集中，甚则失神狂乱
B. 精神萎靡不振，气短乏力
C. 二便失禁，昏厥，遗精
D. 纳呆，腹胀
E. 心悸，惊恐不安

正确答案：B。精神萎靡不振，气短乏力

解析：悲则气消：指过度悲忧伤肺，导致肺气耗伤、肺失宣降的病机变化。临床常见精神不振，意志消沉，胸闷气短，懒言乏力等症（B对）。喜则气缓：指过度喜乐伤心，导致心气涣散不收，重者心气暴脱、神不守舍的病机变化，临床可见精神不集中，神志失常，狂乱（A错）。恐则气下：指过度恐惧伤肾，致使肾气不固、气陷于下的病机变化，临床可见大恐引起的二便失禁，甚则遗精等症（C错）。思则气结：指过度思虑伤脾，导致脾气结滞、运化失职的病机变化，临床可见精神萎靡，反应迟钝，不思饮食，腹胀纳呆，便溏等症状（D错）。惊则气乱：指猝然受惊伤及心肾，导致心神不定、气机逆乱、肾气不固的病机变化，临床可见惊悸不安，慌乱失措，甚则神志错乱，二便失禁等症（E错）。